分泌促胃液素的细胞是
A. 肥大细胞
B. 主细胞
C. G细胞
D. 壁细胞
E. 黏液细胞

正确答案：C。G细胞

解析：G细胞主要分泌促胃液素（C对）。肥大细胞胞质内的异染性颗粒含有组胺、5-羟色胺等化学介质和神经肽、细胞因子等神经调质及过氧化物酶等多种酶类，但不分泌促胃液素（A错）。主细胞主要分泌胃蛋白酶原（B错），壁细胞主要分泌胃酸和内因子（D错），粘液细胞主要分泌粘液（E错）。